多根多处肋骨骨折患者，最典型的症状和体征是
A. 疼痛剧烈
B. 呼吸困难
C. 伤处肿胀青紫
D. 反常呼吸运动
E. 胸廓挤压痛

正确答案：D。反常呼吸运动

解析：多根多处肋骨骨折患者，最典型的症状和体征是反常呼吸运动（D对），即吸气时肋骨骨折软化区胸壁内陷，呼气时外突，严重时可引起呼吸、循环衰竭。疼痛剧烈（A错）、呼吸困难（B错）、伤处肿胀青紫（C错）、胸廓挤压痛（E错）均为肋骨骨折的一般表现，无特异性。